用于检测牙表面菌斑内产酸菌产酸能力的龋活性试验是
A. Dentobuff Strip试验
B. Cariostat试验
C. Dentocult LB试验
D. Dentocult SM试验
E. 刃天青纸片法

正确答案：B。Cariostat试验

解析：本题考查实验室检测评估。用于检测牙表面菌斑内产酸菌产酸能力的龋活性试验是Cariostat试验（B对）。Dentobuff Strip试验的目的：了解唾液的缓冲能力（A错）；Cariostat试验的目的：检测牙表面菌斑内产酸菌的产酸能力；Dentocule LB试验的目的：主要观察乳杆菌在唾液的数量（C错）；Dentocult SM试验的目的：观察唾液中每毫升菌落形成单位（CFU/ml）的变形链球菌数量来判断龋的活性（D错）；刃天青纸片法的目的：用颜色显色法，观察唾液内变形链球菌的数量（E错）。